异烟肼和利福平长期联合应用可能引起
A. 肺气肿
B. 胃溃疡
C. 胆结石
D. 胰腺炎
E. 肝坏死

正确答案：E。肝坏死

解析：本题考查药物的联合应用。异烟肼和利福平长期联合应用可能引起肝坏死（E对）。异烟肼与乙硫异烟胺、吡嗪酰胺、利福平等其他有肝毒性的抗结核药物药合用时，可增加本品的肝毒性，尤其已有肝功能损害者或为异烟肼快乙酰化者，因此在疗程的前3个月应密切随访有无肝毒性征象出现。